金瓷冠可用于
A. 前牙错位牙
B. 锥形牙
C. 固定桥固位体
D. 四环素牙
E. 以上都是

正确答案：E。以上都是

解析：本题考查金瓷冠的适应证。金瓷冠兼有金属全冠的强度和烤瓷全冠的美观颜色、外观逼真，色泽稳定，表面光滑，耐磨性、抗折性强，耐腐蚀，适应症很广泛。前牙错位牙（A对）、锥形牙（B对）、四环素牙（D对）可以用金瓷冠来恢复正常的位置、形态、色泽，也可以作为固定桥固位体（C对），更美观。还可以用作牙周病矫形的固定夹板，经桩核修复的残冠残根和大的牙体缺损的修复。（ABCD均对，故E为本题的正确答案）。